关于听觉性语言中枢的位置
A. 中央后回
B. 角回
C. 颞上回后部
D. 颞中回后部
E. 颞横回

正确答案：C。颞上回后部

解析：听觉性语言中枢的位置在颞上回后部（C对），此中枢主要负责调整自己的语言和听到、理解别人的语言，损伤后可出现病者虽能听到别人讲话，但不理解讲话的意思，自己讲的话混乱而割裂，答非所问，不能正确回答问题和正常说话，称感觉性失语症。中央后回（A错）为第Ⅰ躯体感觉区，此中枢接受背侧丘脑腹后核传来的对侧半身痛、温、触、压以及位置和运动觉，损伤后可出现对侧半身浅、深感觉减退甚至丧失。角回（B错）、颞中回后部（D错）为Wernicke区的组成部分，与理解别人的语言及文字密切相关，该区损伤后可出现感觉性失语症。颞横回（E错）为听觉中枢，每侧听觉中枢都接受来自两耳的冲动，因而一侧听觉中枢受损不致引起全聋。